风湿性心脏病患者行心瓣膜置换术后使用华法林，可发生的典型不良反应是
A. 低血糖
B. 血脂升高
C. 出血
D. 血压降低
E. 肝脏损伤

正确答案：C。出血

解析：本题考查药物的相互作用。风湿性心脏病患者行心瓣膜置换术后使用华法林，可发生的典型不良反应是出血（C对）。华法林属于香豆素类抗凝剂，可对抗维生素K，从而抗凝。但过度出血容易造成出血风险。